维生素B₁₂缺乏可引起的病症是
A. 高同型半胱氨酸血症
B. 脂溢性皮炎
C. 总脂质蓄积
D. 小细胞性贫血
E. 高胆固醇血症

正确答案：A。高同型半胱氨酸血症